女，9个月，8Kg。发热、呕吐腹泻3天，大便蛋花汤样，无腥臭味，尿量明显少。精神萎靡，皮肤弹性差，眼凹陷，唇樱红，四肢凉，诊断为婴儿腹泻，血钠132mmol/L。第一天补液种类应选择
A. 2：1液
B. 2：3：1液
C. 维持液
D. 1.4％碳酸氢钠
E. 10％葡萄糖液

正确答案：B。2：3：1液

解析：该患儿有腹泻的病史，并且有尿量明显少、精神萎靡、皮肤弹性差、眼凹陷、四肢凉的临床表现，应诊断为中度脱水，该患儿血钠132mmol/L，应诊断为等渗性脱水，综上该患儿为中度等渗性脱水，通常等渗性脱水应选择1/2张液，只有2：3：1液是1/2液（B对）。